为比较某新药与常规药治疗贫血的疗效是否有差别，将80名中度贫血的10岁男童按身高、体重相近配成40对。将对子中的两名患者随机分为两组，一组给予新药，另一组给予常规药物。经过一个疗程的治疗后，测量其血红蛋白增加量（g/L）。假设新药组和常规药物组的血红蛋白增加量服从正态分布，应采用的假设检验方法为
A. χ²检验
B. 配对t检验
C. 成组t检验
D. 配对设计差值的符号秩和检验
E. 成组设计两样本比较的秩和检验

正确答案：B。配对t检验